关于率的标准化叙述中错误的是
A. 标准化率也称调整率
B. 率的标准化是采用统一的标准进行计算
C. 率的标准化可按已知条件选择计算方法
D. 标准化率要高于实际率
E. 标准化率常用于反映总体率间相互对比的水平

正确答案：D。标准化率要高于实际率